对正常足月新生儿，暂不能引出的神经反射是
A. 吮吸反射
B. 拥抱反射
C. 握持反射
D. 腹壁反射
E. 觅食反射

正确答案：D。腹壁反射

解析：新生儿，是指自娩出脐带结扎至28天内的婴儿。新生儿出生时具备多种原始反射（P97），包括：吸吮反射（A对）、拥抱反射（B对）、握持反射（C对）、觅食反射（E对），上述反射数月自然消失；腹壁反射（D错，为本题正确答案）及KernIg征、BabⅠnskⅠ征等病理性反射（注意区别病理性反射和病理征，前者为阴性表现，无病理意义；后者为阳性表现，病理意义为中枢神经受损），只有在年长儿才可见到。